炙桑叶多用于
A. 清肺热
B. 疏风热
C. 清肝热
D. 清血热
E. 润肺燥

正确答案：E。润肺燥

解析：桑叶的功效为疏散风热，清肺润燥，平抑肝阳，清肝明目。本品蜜炙能增强润肺止咳的作用，故肺燥咳嗽多用蜜炙桑叶（E对）。